在病例对照研究中，病例组有暴露史的比例显著高于对照组，则可认为
A. 暴露与该病有因果联系
B. 暴露是该病的原因
C. 该病是由这种暴露引起的
D. 该病与暴露存在联系
E. 该疾病与暴露无关

正确答案：D。该病与暴露存在联系

解析：本题考查病例对照研究的原理。在病例对照研究中，如果病例组的暴露比例高于对照组，说明该暴露可能会增加疾病发生的
危险，反之，病例组的暴露比例低于对照组，则该暴露可能会降低疾病发生的危险。题中病例组暴露史的比例显著高于对照组，则可认为该病与暴露存在联系（D对ABCE错）。